王某，男，69岁。患后项部有头疽月余，症见疮形平塌，根盘散慢，疮色紫滞。疮腐难脱，脓水稀少，身热不高，唇燥口干，舌红苔薄黄中剥，脉细数，伴有消渴证。治疗应首选
A. 仙方活命饮
B. 托里消毒散
C. 竹叶黄芪汤
D. 十全大补汤
E. 五味消毒饮

正确答案：C。竹叶黄芪汤

解析：患者伴有消渴证，可知其素为阴虚体质，水亏火炽，则热毒更甚，故见肿势平塌，根脚散漫，皮色紫滞，脓腐难化，虚火灼伤血脉则见脓水稀少或带血水，疼痛明显，阴液亏虚，虚火旺盛，则见身热不高，唇燥口干，舌红苔薄黄中剥，脉细数均为阴虚火炽之证，治宜竹叶黄芪汤，可滋阴生津，清热托毒（C对）。仙方活命饮具有清热解毒，消肿散结，活血止痛之功效，适于热盛肉腐的锁喉痈或余毒未清的窦道（A错）。托里消毒散具有消肿，溃脓，生肌之功，适于气血不足的手发背、褥疮、窦道（B错）。十全大补汤具有补气养血之功，适于气血两虚的流痰（D错）。五味消毒饮具有清热解毒之功，适于火毒乳络的红丝疔（E错）。